大脑中动脉
A. 来自基底动脉
B. 皮质支主要营养半球上外侧面的大部分和岛叶
C. 中央支供应脑干
D. 发出脉络丛前动脉
E. 参与组成大脑动脉环

正确答案：B。皮质支主要营养半球上外侧面的大部分和岛叶

解析：大脑中动脉来自颈内动脉（A错），向外行入外侧沟内，分为数条皮质支，营养半球上外侧面的大部分和岛叶（B对）。大脑中动脉途经前穿质时，发出中央支，又称豆纹动脉，垂直向上进入脑实质，营养尾状核、豆状核、内囊膝和后肢的前部（C错）。脉络丛前动脉（D错）是颈内动脉的分支，不是大脑中动脉的分支。大脑动脉环的组成包括两侧大脑前动脉起始段、两侧颈内动脉末段、两侧大脑后动脉及前、后交通动脉，不包括大脑中动脉（E错）。